强心苷心肌毒性的发生机制是
A. 激活心脏细胞膜Na⁺-K⁺-ATP酶
B. 抑制心肌细胞膜Na⁺-K⁺-ATP酶
C. 增加心肌细胞中的K⁺
D. 增加心肌细胞中的Ca²⁺
E. 增加心肌细胞中的Na⁺

正确答案：B。抑制心肌细胞膜Na⁺-K⁺-ATP酶